具有吡喃醛糖结构的有
A. 果糖
B. 甘露糖
C. 核糖
D. 半乳糖
E. 葡萄糖

正确答案：B、D、E。甘露糖；半乳糖；葡萄糖

解析：本题考查的是糖类的结构。具有吡喃醛糖结构的有甘露糖（B对）、半乳糖（D对）与葡萄糖（E对）。在天然糖苷中，果糖（A错）和核糖（C错）是呋喃糖，阿拉伯糖二者都有，葡萄糖、半乳糖和甘露糖一般为吡喃糖。